与洗涤剂有关的环境内分泌干扰物质是
A. 二噁英
B. 双酚
C. DDT
D. PCDD
E. 壬酚

正确答案：B。双酚

解析：本题考查环境内分泌干扰物。内分泌干扰化学物是对维持机体内环境稳态和调节发育过程的体内天然激素的生成、释放、转运、代谢、结合、效应造成严重影响的一类外源性物质，双酚（B对ACDE错）是与洗涤剂有关的环境内分泌干扰物质。